随访期终止时，仍存活的病例数与随访期满的全部病例数比值为
A. 患病率
B. 病残率
C. 发病率
D. 生存率
E. 病死率

正确答案：D。生存率

解析：存活率又称生存率，指随访期终止时仍存活的病例数与随访期满的全部病例数之比。掌握“流行病学资料与疾病分布”知识点。